镜下见小叶内导管囊状扩张，导管上皮增生，唇腺活检表现为腺体萎缩，间质中淋巴细胞浸润可提示
A. 天疱疮
B. 慢性复发性腮腺炎
C. 活动期牙周炎
D. 急性化脓性颌骨骨髓炎
E. 舍格伦综合征

正确答案：B。慢性复发性腮腺炎

解析：慢性复发性腮腺炎镜下见小叶内导管囊状扩张，导管上皮增生，囊壁为一至数层扁平上皮，囊腔可融合；附近导管周围有淋巴细胞浸润或形成淋巴滤泡；腺泡细胞萎缩。唇腺活检表现为腺体萎缩，间质中淋巴细胞浸润。掌握“慢性唾液腺炎的病理变化”知识点。